评价医德行为善恶的根本标准是
A. 病人的意见
B. 病人家属的意见
C. 新闻媒体的认定
D. 有利于病人有利于医学发展有利于生存环境的改善
E. 社会主义医德规范体系

正确答案：D。有利于病人有利于医学发展有利于生存环境的改善

解析：医德评价的客观标准主要有疗效标准、社会标准和科学标准。疗效标准即医疗行为是否有利于患者的康复或疾患的缓解和根除。社会标准即医疗行为是否有利于人类生存环境的保护和改善。科学标准即医疗行为是否有利于医学科学的发展和进步（D对）。